男，59岁。排尿困难2年。2年来排尿困难逐渐加重，表现为尿线变细，尿滴沥。夜尿3～4次。无尿痛及肉眼血尿，直肠指检及B超诊断为前列腺增生，确定排尿梗阻程度的有效检查方法是
A. 尿流率检查
B. 膀胱镜
C. 残余尿测定
D. CT
E. MRI

正确答案：A。尿流率检查

解析：患者老年男性，排尿不畅，根据临床表现、病史、辅助检查，诊断为前列腺增生。前列腺增生通常做直肠指检、超声、尿流率检查和血清前列腺特异性抗原测定。尿流率检查（A对）可以确定前列腺增生病人排尿的梗阻程度。检查时要求排尿量在150ml以上，如最大尿流率＜15ml/s表面排尿不畅；如＜10ml/s则表面梗阻较为严重，常是手术指征之一。如需进一步了解逼尿肌功能，明确排尿困难是否由于其他膀胱神经源性病变所致，应行尿流动力学检查。IVU、CTU和膀胱镜检查（B错）等，可以除外合并有泌尿系统肿瘤的可能。残余尿更加反映膀胱收缩的能力，即能不能把尿挤干净，侧面反映路通不通 尿流率就直接看路通不通（C错）。